关于固有口腔，何者错了
A. 固有口腔是位于上、下牙弓后内侧的部分
B. 向后经咽峡通咽
C. 当上、下牙列咬合时，不能与口腔前庭相通
D. 顶壁为腭
E. 具有感受味觉、咀嚼食物和协助发音的功能

正确答案：C。当上、下牙列咬合时，不能与口腔前庭相通

解析：固有口腔是位于上、下牙弓后内侧的部分(A对)，向后经咽峡与通咽(B对)，上下牙咬合时，固有口腔与口腔前庭通过第3磨牙后方间隙相通(C错，为本题正确答案)，顶壁为腭(D对)，固有口腔内的舌，牙等共同运作，具有感受味觉、咀嚼食物及协助发音的功能(E对)。